皂苷的理化性质有
A. 荧光性
B. 水溶性
C. 发泡性
D. 溶血性
E. 水解性

正确答案：B、C、D、E。水溶性；发泡性；溶血性；水解性

解析：本题考查的是皂苷的理化性质。皂苷的理化性质有水溶性（B对）、发泡性（C对）、溶血性（D对）与水解性（E对）。皂苷的理化性质：1.性状：（1）皂苷分子量较大，不易结晶，大多为无色或乳白色无定型粉末。（2）皂苷多数具有苦而辛辣味，其粉末对人体黏膜有强烈的刺激性，鼻内黏膜尤其敏感。（3）皂苷大多具有吸湿性，应干燥保存。（4）多数三萜皂苷都呈酸性。2.溶解度：大多数皂苷极性较大，易溶于水、热甲醇和乙醇等极性较大的溶剂，难溶于丙酮、乙醚等有机溶剂。3.发泡性：皂苷水溶液经强烈振荡能产生持久性的泡沫，且不因加热而消失。4.溶血性：皂苷的水溶液大多能破坏红细胞，产生溶血现象。5.熔点与旋光度：皂苷常在熔融前就已经分解，因此无明显的熔点，一般测的都是分解点。测定旋光度对判断皂苷的结构有重要意义。6.皂苷的水解：皂苷苷键的裂解，通常可采用一般苷类化合物苷键裂解的方法，如酸催化水解、氧化水解和酶解等。7.显色反应：皂苷通常应用的显色反应有Liebermann反应、醋酐-浓硫酸反应、三氯乙酸反应、五氯化锑反应及芳香醛-硫酸或高氯酸反应。荧光性（A错）为香豆素的理化性质。香豆素的荧光性质：香豆素类在可见光下为无色或浅黄色结晶。香豆素母体本身无荧光，而羟基香豆素在紫外光下多显出蓝色荧光，在碱溶液中荧光更加显著。香豆素类荧光与分子中取代基的种类和位置有一定关系：一般在C-7位引入羟基即有强烈的蓝色荧光，加碱后可变为绿色荧光；但在C-8位再引入一羟基，则荧光减至极弱，甚至不显荧光。呋喃香豆素多显蓝色荧光，荧光性质常用于色谱法检识香豆素。